与明胶试剂产生沉淀的是
A. 没食子酸
B. 绿原酸
C. 二者均有
D. 二者均无

正确答案：D。二者均无

解析：本题考查的是鞣质性质和结构。与明胶试剂产生沉淀是鞣质（D对）。鞣质与蛋白质作用：鞣质可与蛋白质结合生成不溶于水的复合物沉淀。实验室一般使用明胶进行鉴别、提取和除去鞣质。没食子酸（A错）为没食子酸鞣质的水解产物。没食子酸鞣质水解后可产生没食子酸（或其缩合物）和多元醇。绿原酸（B错）为一分子咖啡酸与一分子奎宁酸结合而成的酯，即3-咖啡酰奎宁酸，不属于鞣质。